某女怀孕后，非常想知道胎儿的性别，逐请好友某妇产科医师为其做胎儿性别签定。该医师碍于情面实施胎儿性别鉴定。根据《母婴保健法》的规定，当地卫生计生行政部门应对该医师作出的处理是
A. 处以罚款
B. 给予行政处分
C. 扣发年度奖金
D. 调离工作岗位
E. 离岗接受培训

正确答案：B。给予行政处分